女，60岁。身高170cm，体重65kg，每天所需基本热量约为
A. 1235kcl
B. 1035kcal
C. 1625kal
D. 755kcal
E. 2560kcal

正确答案：C。1625kal

解析：此题为旧题目，依然按照七版外科学（七版外科学P138）观点进行计算：以公斤体重计，每天基本需要量为25kcal。故该患者每天所需基本热量约为25×65=1625kal（C对）。八版外科学（P108）认为：对于无法实际测定静息能量消耗的病人（BMI＜30），推荐的能量摄入量为20～25kcal/（kg·d）；BMI≥30的病人，推荐的能量摄入量应为正常需要量的70%～80%。该患者BMI＜30（BMI=体重（kg）/身高2（m²）），故其每天所需基本热量约为1300～1625kcal之间。需注意：每天所需基本热量为REE，用25kcal/（kg·d）或20～25kcal/（kg·d）乘以体重进行计算，而基础能量消耗BEE用Harris-Benedict公式进行计算，注意区分两者之间的区别。